采用高氯酸滴定液滴定下述药物时，需在滴定前预先加入醋酸汞试液的是
A. 盐酸麻黄碱
B. 硫酸阿托品
C. 盐酸吗啡
D. 硝酸士的宁
E. 氯氮䓬

正确答案：A、C。盐酸麻黄碱；盐酸吗啡